患者女，56岁，既往有高血压、高脂血症病史，长期服用依那普利片、阿托伐他汀钙片。现因上腹痛2周，伴黑便数日就诊。患者自诉3周前因膝关节痛，服用布洛芬，疼痛未缓解，自行加用萘普生。胃镜检查显示胃窦小弯侧有一约7mm溃疡，幽门螺杆菌(Hp）阳性。肾功能未见异常。患者溃疡治愈后，因膝关节痛，需要长期服用非甾体抗炎药。为降低溃疡发生风险，首选的预防药物是
A. 奥美拉唑
B. 多潘立酮
C. 替普瑞酮
D. 枸橼酸铋钾
E. 西咪替丁

正确答案：A。奥美拉唑

解析：本题考查奥美拉唑。为降低溃疡发生风险，首选的预防药物是奥美拉唑（A对）。胃黏膜保护剂米索前列醇用于NSAIDs引起的胃黏膜损害，但腹泻、腹痛、呕吐等胃肠道不良反应使许多患者难以耐受，所以对于必须长期服用阿司匹林的患者首选同时服用PPI，即奥美拉唑。多潘立酮（B错）用于消化不良、腹胀、嗳气、恶心、呕吐、腹部胀痛。替普瑞酮（C错）用于急性胃炎、慢性胃炎急性加重期，胃黏膜病变（糜烂、出血、潮红、浮肿）的改善及胃溃疡。枸橼酸铋钾（D错）用于慢性胃炎及缓解胃酸过多引起的胃痛、胃灼热感（烧心）和反酸。西咪替丁（E错）用于缓解胃酸过多引起的胃痛、胃灼热感（烧心）、反酸。